治疗胎儿生长受限胞宫虚寒证，应首选的方剂是
A. 寿胎丸
B. 人参养荣汤
C. 保阴煎
D. 胎元饮
E. 长胎白术散

正确答案：E。长胎白术散

解析：胎儿生长受限是由于病理原因造成的出生体重低于同孕龄同性别胎儿平均体重的两个标准差或第10百分位数，或足月胎儿出生体重小于2500克，实质是胎儿的生长未能达到其潜在应有的生长速率。胎儿生长受限胞宫虚寒证的病机是胞宫虚寒，胎失温养；治宜温肾扶阳，养血育胎，选用长胎白术散（E对）加巴戟天、艾叶。寿胎丸（A错）用于肾气亏虚证；保阴煎（C错）用于阴虚内热证；胎元饮（D错）或人参养荣汤（B错）用于气血虚弱证。